在一个研讨班上，学员对假劣药情形、使用法律和法律责任展开了讨论。讨论的情形主要包括五个，一是某药厂未经批准擅自委托生产药品；二是某药品未标明有效期；三是直接接触药品的包装材料未经批准；四是在生物制品中擅自添加着色剂；五是生物制剂中擅自添加防腐剂。未标明药品有效期的行为应当
A. 认定为假药
B. 按假药论处
C. 认定为劣药
D. 按劣药论处
E. 会出现不良反应

正确答案：D。按劣药论处

解析：不注明或者更改生产批号的属于按劣药论处的情形。掌握“药品管理及法律责任”知识点。